左上尖牙（牙合）面窝沟的龋损，黑色沉着区下方为龋白斑，可以诊断为
A. 窝沟浅龋
B. 窝沟中龋
C. 窝沟深龋
D. 牙本质敏感
E. 牙髓炎

正确答案：A。窝沟浅龋

解析：本题考查龋病的诊断及鉴别诊断。窝沟浅龋（A对）可表现为龋损部位色泽变黑，进一步仔细观察可发现黑色沉着区下方为龋白斑，呈白垩色改变。